下列属外用膏剂者为
A. 橡皮膏剂
B. 膜剂
C. 膏药
D. 锭剂
E. 软膏剂

正确答案：A、C、E。橡皮膏剂；膏药；软膏剂

解析：本题考查的是外用膏剂的分类。下列属外用膏剂者为橡胶膏剂（A对）、膏药（C对）与软膏剂（E对）。外用制剂按基质及形态分类如下。（1）软膏剂与乳膏剂：软膏剂与乳膏剂均为半固体外用膏剂，主要用于皮肤的局部治疗，对皮肤有保护、润滑、消炎和止痒等作用。软膏剂根据基质组成不同，可分为油脂性基质软膏和水溶性基质软膏。乳状液型基质制成的为乳膏剂。（2）贴膏剂与贴剂：贴膏剂系指将原料药物与适宜的基质制成膏状物，涂布于背衬材料上供皮肤贴敷、可产生全身性或局部作用的一种薄片状制剂。按基质组成可分为：以橡胶为主要基质的橡胶贴膏和以亲水性高分子材料为基质的凝胶贴膏。贴剂系指原料药物与适宜的材料制成的供粘贴在皮肤上的可产生全身性或局部作用的一种薄片状制剂。（3）膏药：膏药系指饮片、食用植物油与红丹（铅丹）或官粉（铅粉）炼制成膏料，摊涂于裱褙材料上制成供皮肤贴敷的外用制剂。膜剂（B错）系指原料药物与适宜的成膜材料经加工制成的膜状制剂。供口服或黏膜用。锭剂（D错）系指饮片细粉加适宜黏合剂（或利用饮片细粉本身的黏性）制成不同形状的固体制剂。有长方形、纺锤形、圆柱形、圆锥形等。供内服，可吞服或研细以水或黄酒化服，外用多是研细用醋或酒调敷，也可作嗅入或外搽药用。